患儿女，2岁，因发热、咳嗽2天，加重伴气促而入院。体温在39～40℃。一般状态差，面色苍白。双肺可闻及细湿啰音。全身皮肤弥散性充血发红，有红色细小丘疹，压之暂呈苍白。X线胸片见肺浸润。该病例最可能的诊断是
A. 腺病毒肺炎
B. 呼吸道合胞病毒肺炎
C. 葡萄球菌肺炎
D. 革兰阴性杆菌肺炎
E. 肺炎支原体肺炎

正确答案：C。葡萄球菌肺炎